在健康状况的综合评价指标中，哪项是目前最常用的指标
A. 平均期望寿命
B. 病残调整生存年
C. 潜在减寿人年数
D. 健康期望寿命

正确答案：B。病残调整生存年

解析：本题考查目前最常用的健康状况的综合评价指标。在健康状况的综合评价指标中，伤残调整生命年（B对ACD错）是目前最常用的指标。伤残调整生命年是疾病死亡损失健康生命年与疾病伤残（残疾）损失健康生命年相结合的指标，是生命数量和生活质量以时间为单位的综合性指标。